关于药品码放的说法，错误的是
A. 按药理作用码放
B. 经常调换位置码放
C. 相同成分、相同剂型，不同规格的药品应当分开码放
D. 包装相似或读音相似的药品应分开码放
E. 高危药品货位座应当加贴高危药品标识，避免调剂错误

正确答案：B。经常调换位置码放

解析：本题考查药品码放。药品的码放应有利于药品调配，药品可按中、英文的首字字母顺序，或按药理作用系统，制剂剂型进行分类并不宜经常调换位置（B错，为本题正确答案）。